男性，45岁。诉左下颌后牙出现不适6个月求治。口腔检查：左下56残冠，叩诊（±），松动（-），已做过牙髓治疗，牙龈稍红，无法再修复，拟拔除。口内其他牙未见明显异常。X线片示：左下6远中根尖有阴影，距离下颌神经管较近。左下56拔除时断根，颊侧切开去骨后取出，2天后出现激烈疼痛，并向耳颞部、下颌下区放散。口内检查：左下56牙槽窝有腐败变性的残留血凝块，有恶臭。引起疼痛的原因是干槽症，最佳应急处理方法是局麻下彻底去除牙槽窝内腐败物，冲洗后填入碘仿纱条。假如处理7天后疼痛消失，但左侧口唇及颊部麻木感，为确定诊断应做
A. 牙槽窝探查
B. 摄X线片
C. 邻牙探诊
D. 局麻定位检查
E. 以上均需做

正确答案：B。摄X线片

解析：本题考查下牙槽神经损伤的确诊方法。下颌后牙拔牙术后左侧口唇及颊部麻木感，考虑为左侧下牙槽神经损伤，应该拍摄X线片（B对），观察下颌管是否有损伤，以确定下牙槽神经是否受损。干槽症治疗7天后，牙槽窝虽然空虚，但骨壁表面已有一层肉芽组织覆盖，不能进行牙槽窝探查（A错），且探查也不能确定下颌管是否有损伤。邻牙探诊（C错）可以通过邻牙牙齿及牙龈对探诊的反映来推测下牙槽神经是否有损伤，但这种探诊结果准确性不高，且结果会受下牙槽神经损伤程度影响，因此只能协助诊断，不能确诊。局麻定位检查（D错）时，若下牙槽神经正常，阻滞麻醉时该侧口唇及颊部会麻木；若下牙槽神经受损，该侧口唇及颊部本就是麻木的，因此局麻定位检查不能判定下牙槽神经是否受损。